在大唾液腺中，多形性腺瘤最常见于
A. 下颌下腺
B. 舌下腺
C. 腮腺
D. 唇腺
E. 腭腺

正确答案：C。腮腺

解析：在大唾液腺中，多形性腺瘤最常见于腮腺，其次为下颌下腺，舌下腺极少见。发生于小唾液腺者，以腭部为最常见。任何年龄均可发生，但以30～50岁为多见，女性多于男性。掌握“多形性腺瘤”知识点。